一个国家或地区，60岁以上人口数达到总人口数的百分之多少或多少岁以上人口达到总人口的7%称为老龄化社会
A. 5%，65
B. 7%，65
C. 10%，65
D. 10%，70
E. 10%，80

正确答案：C。10%，65